某人全天需热能约2400千卡，按蛋白质供热占总热能10％计，全日应供给蛋白质多少克
A. 26.7克
B. 24.0克
C. 60.0克
D. 70.0克
E. 80.0克

正确答案：C。60.0克

解析：蛋白质供能为240千卡，每克蛋白质供能4千卡，所以需蛋白质60克